下列哪种是釉质形成缺陷症的遗传类型
A. 常染色体显性遗传
B. 常染色体隐性遗传
C. X性连锁显性遗传
D. X性连锁隐性遗传
E. 以上都是

正确答案：E。以上都是

解析：釉质形成缺陷为遗传性的釉质发育异常。遗传类型包括常染色体显性遗传、常染色体隐性遗传、X染色相关型（X性连锁显性遗传、X性连锁隐性遗传）。其中较常见的为常染色体显性型，较少见的为X染色体相关型。掌握“釉质形成缺陷（釉质发育不全）”知识点。